眶下神经阻滞麻醉口外注射时进针点是
A. 鼻翼旁约0.5cm处
B. 鼻翼旁约1cm处
C. 鼻翼旁约1.5cm处
D. 鼻翼旁约2cm处
E. 鼻翼旁约2.5cm处

正确答案：B。鼻翼旁约1cm处

解析：本题考查颌面部常用局麻法及牙拔除的麻醉选择。眶下神经阻滞麻醉口外注射法：注射时用左手示指扪得眶下缘，右手持注射器，注射针自同侧鼻翼旁约1cm处（B对）刺入皮肤，使注射针与皮肤成45°角，向上后外进针约1.5cm，可直接刺入眶下孔，有时针尖抵触骨面不能进入眶下孔，可注入少量麻药，使局部无痛，然后移动针尖探寻眶下孔，直到其进入眶下孔内，随即注射麻药1～1.5ml。注意注射针进入眶下管不可过深，以免伤及眼球。